下列属于麻子仁丸组成的是
A. 大黄、厚朴、枳实
B. 芒硝、大黄、甘草
C. 芒硝、厚朴、枳实
D. 芍药、大黄、甘草
E. 杏仁、大黄、甘草

正确答案：A。大黄、厚朴、枳实

解析：麻子仁丸方中麻子仁性味甘平，质润多脂，功能润肠通便，是为君药。杏仁上肃肺气，下润大肠；白芍养血敛阴，缓急止痛为臣。大黄、枳实、厚朴（A对）即小承气汤，以轻下热结，除胃肠燥热为佐。蜂蜜甘缓，既助麻子仁丸润肠通便，又可缓和小承气汤攻下之力，以为佐使。方歌：麻子仁丸小承气，杏芍麻仁治便秘，胃热津亏解便难，润肠通便脾约济。